进行meta分析时，如果各研究间无统计学异质性，采用
A. 随机效应模型
B. 亚组分析
C. 固定效应模型
D. 敏感性分析
E. meta回归

正确答案：C。固定效应模型

解析：本题考查Meta分析中异质性资料处理的方法。异质性的处理：1.忽略异质性：固定效应模型（C对D错）合并；2.异质性过大：不合并；3.轻度异质性：随机效应模型（A错）合并；4.解释：亚组分析（B错）和meta回归（E错）。